小儿4个月，人工喂养，平时易惊，多汗，睡眠少，近2日来咳嗽低热，今晨突然双眼凝视，手足抽动。查体：枕后有乒乓球感。可能的诊断是
A. 热性惊厥
B. 低血糖症
C. 颅内感染
D. 低钠血症
E. 营养性维生素D缺乏性佝偻病

正确答案：E。营养性维生素D缺乏性佝偻病

解析：4个月患儿有枕后乒乓球感、双眼凝视、手足抽动的临床变现，可诊断为维生素d缺乏性佝偻病（E对）。热性惊厥的体温﹥38℃，而该患儿是急性呼吸道感染引起的低热（A错）。血糖降低一般会有清晨空腹、进食不足或腹泻的病史，因此该患儿不会出现血糖降低的情况（B错）。颅内感染的临床表现为头剧烈疼痛、颅缝增大、频繁呕吐等颅内高压的表现，与该患儿的表现不符（C错）。血清钠降低一般见于幼儿腹泻的情况，会有眼窝凹陷、皮肤干燥、口渴等脱水的表现（D错）。